《执业医师法》规定，医师因考核不合格者被责令暂停执业活动3～6个月，并接受培训和继续医学教育，期满后仍然不合格者，由县级以上卫生行政部门对其
A. 变更注册
B. 不予注册
C. 重新注册
D. 注销注册
E. 暂缓注册

正确答案：D。注销注册

解析：根据《执业医师法》规定，对考核不合格的医师，县级以上卫生行政部门可以责令医师暂定执行活动3～6个月，接受培训和继续医学教育，期满后仍然不合格的，则注销注册（D对），收回医师执业证书。医师变更执业地点、执业类别、执业范围等注册事项的，应当到准予注册的卫生行政部门依照规定办理变更注册（A错）手续（P246）。《医师执业注册暂行办法》规定，有下列情形之一的，不予注册（B错）：①不具有完全民事行为能力的；②因受刑事处罚，自刑罚执行完毕之日起至申请注册之日止不满2年的；③受吊销医师执业证书行政处罚，自处罚决定之日起至申请注册之日止不满2年的；④甲类、乙类传染病传染期、精神病发病期以及身体残疾等健康状况不适宜或者不能胜任医疗、预防、保健业务工作的；⑤重新申请注册，经卫生行政部门指定机构或组织考核不合格的；⑥有国务院卫生行政部门规定不宜从事医疗、预防、保健业务的其他情形的（P245）。《执业医师法》规定，中止医师执业活动2年以上以及不予注册的情形消失的，申请重新执业，应当依法重新注册（C错）（P246）。